有关柠檬酸-丙酮酸循环的叙述哪一项是不正确的
A. 提供NADH
B. 提供NADPH
C. 使乙酰CoA进入胞液
D. 参与TAC的部分反应
E. 消耗ATP

正确答案：A。提供NADH